有关鼓室的叙述正确的是
A. 位于外耳道与内耳道之间，是一密闭的腔
B. 经咽鼓管通咽腔
C. 内侧壁上有听觉感受器
D. 上壁称鼓室盖，与颅后窝毗邻
E. 以上均正确

正确答案：B。经咽鼓管通咽腔

解析：鼓室是颞骨岩部内（A错）含气的不规则小腔。鼓室经咽鼓管通咽腔（B对）。上壁又称盖壁，分隔鼓室与颅中窝（D错）。听觉感受器螺旋器位于膜迷路的蜗管的下壁（C错）。